高血压合并糖尿病患者，若无禁忌症，首选的降压药物是
A. β受体阻断剂
B. 噻嗪类利尿剂
C. α受体阻断剂
D. 二氢吡啶类钙通道阻滞剂
E. 血管紧张素转换酶抑制剂

正确答案：E。血管紧张素转换酶抑制剂

解析：本题考查降压药。高血压合并糖尿病患者，若无禁忌症，首选的降压药物是血管紧张素转换酶抑制剂（ACEI）（E对）或血管紧张素Ⅱ受体阻滞剂（ARB）；如需联合用药，应以ACEI或ARB为基础，加用利尿剂或二氢吡啶类CCB（D错）；合并心绞痛者可加用β受体阻断剂。糖尿病合并高尿酸血症的患者慎用噻嗪类利尿剂（B错）。反复低血糖发作者，慎用β受体阻断剂（A错），以免掩盖低血糖症状。有前列腺肥大且血压控制不佳的患者可使用α受体阻断剂（C错）。